引起急性肾功能衰竭
A. 肾上腺素
B. 去甲肾上腺素
C. 两者均可
D. 两者均不可

正确答案：B。去甲肾上腺素

解析：本题考查药源性疾病。去甲肾上腺素（B对）为α受体激动药，用药过久或剂量过大可使肾血管强烈收缩，肾血流减少以致严重缺血，引起急性肾衰竭。肾上腺素（A错）为α、β受体激动药，能同时激动血管上的α和β₂受体，与α受体结合产生缩血管作用，与β₂受体结合则产生扩血管作用，不会引起急性肾功能衰竭。